在奇经八脉中，其循行多次与手足三阳经及阳维脉交会的是
A. 冲脉
B. 任脉
C. 督脉
D. 阴维脉
E. 阳跷脉

正确答案：C。督脉

解析：阴维脉“维络诸阴”；阳维脉“维络诸阳”，阴维脉与足三阴经相交会，最后合于任脉（B错）；阳维脉与手足三阳经相交，最后合于督脉（C对）。阴阳相辅，对诸阴阳经脉气血起着溢蓄调节作用。